参与特异性抗细胞外病原体感染的主要免疫效应成分是
A. CTL
B. Th1
C. 巨噬细胞
D. Ig
E. NK细胞

正确答案：D。Ig